高三酰甘油血症患者应首选的药物是
A. 洛伐他汀
B. 辛伐他汀
C. 阿托伐他汀钙
D. 依折麦布
E. 非诺贝特

正确答案：E。非诺贝特

解析：本题考查调血脂药。高三酰甘油血症患者应首选的药物是非诺贝特（E对）。非诺贝特为贝特类调血脂药，可促进TG分解以及胆固醇的逆向转运。主要降低血清TG，也可在一定程度上降低TC和LDL-C，升高HDL-C。洛伐他汀（A错）、辛伐他汀（B错）、阿托伐他汀钙（C错）为他汀类调血脂药，可作为高胆固醇血症的首选药。依折麦布（D错）用于高胆固醇血症和以胆固醇升高为主的混合型高脂血症。